描述血清抗体滴度资料的平均水平宜选用
A. 均数
B. 中位数
C. 几何均数
D. 标准差
E. 四分位数间距

正确答案：C。几何均数

解析：本题考查几何均数的相关内容。一般而言，几何均数（C对ABDE错）适合于原始数据呈正偏态分布但对数转换后呈近似对称分布的数据，尤其是医学研究中遇到的呈现等比例变化的数据，如抗体滴度、血清凝集效价等。